反映口腔疾病及其防治对人们的生理功能、心理功能及社会功能等方面影响的综合评估指标
A. 口腔健康相关生活质量
B. 研究对象的属性
C. 口腔健康知识
D. 口腔健康态度
E. 口腔健康行为

正确答案：A。口腔健康相关生活质量

解析：口腔健康相关生活质量是反映口腔疾病及其防治对人们的生理功能、心理功能及社会功能等方面影响的综合评估指标。掌握“口腔健康问卷调查”知识点。